预防出生缺陷的二级措施是
A. 开展出生缺陷防治的宣传和健康教育
B. 开展婚前保健和咨询指导
C. 开展婚前医学检查
D. 提高孕期出生缺陷发现率
E. 妇女孕前和孕早期增补叶酸

正确答案：D。提高孕期出生缺陷发现率

解析：本题考查预防出生缺陷的二级措施。出生缺陷二级预防措施是指提高孕期出生缺陷发现率（D对ABCE错），主要是在孕期通过早发现、早诊断和早采取措施，以减少出生缺陷儿的出生，包括产前筛查和产前诊断。常用产前诊断方法有早期绒毛活检、母血清三联试验筛查等，在怀孕早期通过取绒毛做胎儿细胞检查，可确定胎儿染色体异常，具有早诊断、早取材、简便易行等优点。